以下哪一项不应是单位和个人应对精神障碍患者保密的是
A. 姓名
B. 资产
C. 肖像
D. 住址
E. 工作单位

正确答案：B。资产

解析：精神障碍患者的人格尊严、人身和财产安全不受侵犯。精神障碍患者的教育、劳动、医疗以及从国家和社会获得物质帮助等方面的合法权益受法律保护。有关单位和个人应当对精神障碍患者的姓名、肖像、住址、工作单位、病历资料以及其他可能推断出其身份的信息予以保密；但是，依法履行职责需要公开的除外。掌握“精神障碍概述、预防、诊断和治疗”知识点。